患者。男，70岁。右上后牙咀嚼时敏感症状。检查见右上6（牙合）面磨耗明显。叩（-），探诊敏感，冷诊（-），无松动。诊断为
A. 浅龋
B. 中龋
C. 牙本质过敏
D. 逆行性牙髓炎
E. 可复性牙髓炎

正确答案：C。牙本质过敏

解析：牙本质过敏临床表现：①表现为激发痛。以机械刺激最为显著，其次为冷、酸、甜等，刺激除去后疼痛立即消失。②用探针尖在牙面上寻找一个或数个敏感点或敏感区，引起患者特殊的酸、软、痛症状。③敏感点多发现在咬合面釉牙本质界、牙本质暴露处或牙颈部釉牙骨质界处；可发现在一个或多个牙上。掌握“牙本质敏感症”知识点。